膳食中丙烯酰胺的主要来源
A. 膳食纤维含量较多的食品
B. 蛋白质含量丰富的食品
C. 油炸和焙烤的淀粉类食品
D. 腌制食品
E. 水分含量高的食品

正确答案：C。油炸和焙烤的淀粉类食品

解析：本题考查膳食中丙烯酰胺的主要来源。丙烯酰胺是一种有机化合物，也是食品加工过程中产生的化学性污染物。其主要来源于油炸和焙烤的淀粉类食品（C对ABDE错）。